处方调配程序中第二项工作是
A. 收方
B. 调配
C. 划价
D. 核查
E. 发药

正确答案：D。核查